男，25岁。腰痛2年。有过2次左眼虹膜炎发作。查体：左足跟轻度肿胀，压痛（+）；右膝肿胀及压痛（+），浮髌实验（+）。实验室检查：HLA-B27（+），血沉32mm/L。最有可能的诊断是
A. 脊柱关节炎
B. 白塞病
C. 类风湿关节炎
D. 痛风关节炎
E. 感染性关节炎

正确答案：A。脊柱关节炎

解析：青壮年男性患者，腰痛2年，病情累及右足跟，血沉加快（强直性脊柱炎多发生于16~30岁的青、壮年，早期表现为下腰痛或骶髂部不适、疼痛或发僵）。根据患者的病史、症状及体征，考虑诊断为强直性脊柱炎（A对）。类风湿性关节炎（P766）（C错）女性多见，表现为反复发作的、对称性的、多发性小关节炎，与HLA-DR4有关。痛风性关节炎（D错）多有饮食多嘌呤食物史，多在夜间突然发病，受累关节剧痛，HLA-B27（-）。感染性关节炎（P746）（E错）多见于儿童，好发于髋关节、膝关节，起病急骤，有寒战高热等症状。